下列哪项不是妊娠期龈炎时引起牙龈炎症的直接因素
A. 菌斑
B. 牙石
C. 食物嵌塞
D. 不良修复体
E. 妊娠

正确答案：E。妊娠

解析：本题考查妊娠期龈炎的病因。妊娠（E对）不是妊娠期龈炎时引起牙龈炎症的直接因素。妊娠期龈炎的发生只是由于妊娠期时激素的水平改变，牙龈对局部刺激的反应增强，使原有的牙龈炎症加重或改变了特性，且牙龈是女性激素的靶器官，妊娠时血液中的女性激素（特别是黄体酮）水平增高，尤其是妊娠期6个月，牙龈毛细血管扩张出血，加重菌斑所引起的炎症反应。菌斑微生物仍然是妊娠期龈炎的直接原因（A错）。妊娠期妇女若不注意保护口腔卫生，致使牙菌斑、牙石在龈炎附近堆积（B错），易引发牙龈炎症，若同时有食物嵌塞（C错）和不良修复体存在（D错），更易加重牙龈的炎症。